患者，女，30岁。10年前患风湿热，查体：心尖部闻及舒张期隆隆样杂音。X线显示左心房增大。应首先考虑的是
A. 二尖瓣关闭不全
B. 二尖瓣狭窄
C. 主动脉瓣关闭不全
D. 主动脉瓣狭窄
E. 肺动脉瓣狭窄

正确答案：B。二尖瓣狭窄

解析：风湿热是由A组乙型溶血性链球菌感染后反复发作的全身结缔组织炎症。可累及心脏瓣膜，以二尖瓣、主动脉瓣和二尖瓣复合病变为主。二尖瓣狭窄心脏杂音为：心尖区舒张中晚期隆隆样杂音，呈递增型；X线显示左心房增大（由于左房室通道受阻，血液淤积于左心房，导致左房扩大）。根据患者风湿热病史，心脏听诊杂音和X线表现，首先考虑为二尖瓣狭窄（B对）。二尖瓣关闭不全（A错）的杂音特点为心尖区收缩期粗糙的吹风样杂音。主动脉关闭不全（C错）杂音特点为主动脉瓣听诊区舒张期高调递减型叹气样杂音。主动脉狭窄（D错）杂音特点为主动脉瓣听诊区收缩期粗糙而响亮的射流性杂音，呈递增-递减型。肺动脉狭窄（E错）杂音特点为肺动脉瓣听诊区收缩期粗糙而响亮的射流性杂音。